妇科病理上的特点是
A. 脏腑功能失常
B. 气血失调
C. 冲任二脉损伤
D. 胞宫胞脉病变
E. 以上都是

正确答案：E。以上都是

解析：中医学认为，致病因素作用于人体，在一定的发病条件下可导致脏腑功能失常，气血失调，冲任督带损伤，胞宫、胞脉、胞络受损，进而引发妇产科疾病（E对ABCD错）。